含有甾体结构的药物是
A. 桂利嗪
B. 氢氯噻嗪
C. 呋塞米
D. 依他尼酸
E. 螺内酯

正确答案：E。螺内酯

解析：本题考查药物结构。含有甾体结构的药物是螺内酯（E对）。螺内酯含有甾体结构，是盐皮质激素受体阻断药，具有保钾利尿的作用。桂利嗪（A错）为三苯基哌嗪类非选择性的钙离子拮抗剂。氢氯噻嗪（B错）属苯并噻嗪类利尿药，为协同转运抑制剂，其结构中有两个磺酰胺基。呋塞米（C错）属于含磺酰胺结构的利尿药。依他尼酸（D错）为苯氧乙酸类强利尿药，作用强且迅速，但对肝脏有损害作用。